男性，50岁。反复咳嗽、咳痰4年，近半年来发作时常伴呼吸困难。体检：双肺散在哮鸣音，肺底部有湿啰音。肺功能测定：1秒钟用力呼气容积/用力肺活量为55％，残气容积/肺总量为35％。诊断应考虑为
A. 慢性单纯型支气管炎
B. 慢性喘息型支气管炎
C. 支气管哮喘
D. 慢性支气管炎合并肺气肿
E. 支气管哮喘合并肺气肿

正确答案：B。慢性喘息型支气管炎